下列关于肿瘤的产生因素除外的是
A. 癌基因激活
B. 癌基因过量表达
C. 抑癌基因的丢失
D. 抑癌基因的失活
E. 抑癌基因的激活

正确答案：E。抑癌基因的激活

解析：癌基因激活与过量表达与肿瘤的形成有关，然而抑癌基因的丢失或失活也可能导致肿瘤发生。掌握“癌基因与抑癌基因以及生长因子”知识点。